以下关于选择性叙述错误的是
A. 选择性是药物分类和临床选药的依据
B. 选择性低的药物作用范围广
C. 选择性低的药物不良反应多见
D. 剂量增大，选择性提高
E. 药物作用的选择性是相对的

正确答案：D。剂量增大，选择性提高

解析：药物作用具有特异性，多数药物发挥作用是通过作用部位的靶位结合后产生，这种对应关系成为药物的选择性，药物选择性是指在全身用药的情况下，药物对机体器官系统作用具有强弱或者有无的差异，选择性是药物分类以及临床疾病选药的依据（A对），不随剂量的改变而改变（D错，为本题正确答案），药物选择性高，作用范围窄，不良反应也少；药物选择性低，作用范围广，临床应用多（B对），不良反应也多（C对），但药物的选择性具有相对性（E对），药物作用特异性强不一定引起选择性高的药理效应，如阿托品特异性阻断M胆碱受体，但其药理效应选择性并不高，对心脏、平滑肌、血管、腺体以及中枢神经系统均有影响。